阿托品颠茄曼陀罗中毒可见
A. 皮肤潮湿
B. 皮肤青紫
C. 皮肤干燥
D. 皮肤黏膜桃红色
E. 皮肤黏膜潮红

正确答案：C。皮肤干燥

解析：阿托品、颠茄、曼陀罗中毒可引起口干、吞咽困难、声音嘶哑、面红、皮肤干燥（C对）、头痛、心动过速、心悸、发热、瞳孔扩大、视力模糊、排尿困难；对中枢神经系统的作可致谵妄、狂躁、眩晕、幻觉、摸空动作和共济失调。中毒症状可持续数小时至数日；病情严重者，发生昏迷、血压下降，最终出现呼吸衰竭而死亡。中毒机制：阿托品类的生物碱能阻断节后胆碱能神经所支配的效应器官中的乙酰胆碱受体（一种重要的神经递质）。过量时，主要表现为副交碱神经作用解除后的症状以及中枢神经系统兴奋，对烟碱样症状则无对抗作用。